窝沟龋的形态描述正确的是
A. 呈菱形
B. 底部朝向牙釉质
C. 尖端朝向牙本质
D. 不会超过釉牙本质界
E. 呈三角形

正确答案：E。呈三角形

解析：有的窝沟龋呈锥形，底部朝向牙本质，尖端朝向釉质表面，而病损可以越过釉牙本质界形成深龋洞。掌握“龋病的临床表现与分类”知识点。